家庭健康询问调查属于
A. 描述性研究
B. 分析性研究
C. 实验性研究
D. 以上都是
E. 以上都不是

正确答案：A。描述性研究

解析：本题考查家庭健康询问调查。家庭健康询问调查是卫生服务研究的重要手段是从需方的角度研究卫生服务的需要、需求、服务利用及费用等。它属于描述性研究（A对BCDE错）。